2岁女孩，突发喘息1天。查体：体温正常，稍气促，两肺广布哮鸣音。母有哮喘史。给予沙丁胺醇气雾剂吸入后，肺部哮鸣音逐渐消失，按评分法该患儿评分是
A. 2分
B. 3分
C. 4分
D. 5分
E. 6分

正确答案：E。6分

解析：凡年龄在3岁以内、哮喘反复发作者的计分原则：①哮喘发作≥3次，计3分；②肺部出现哮鸣音，计2分；③喘息突然发作，计1分；④有其他特应性病史，计1分；⑤1级2级亲属中有哮喘病史，计1分。评分标准为：总分≥5分者诊断为婴幼儿哮喘；如肺部有哮鸣音可做以下试验：①1‰肾上腺素每次0.01mg/kg皮下注射，15～20分钟后若喘息缓解或哮鸣音明显减少者加2分；②予以舒喘灵气雾剂或其水溶液雾化吸入后，观察喘息或哮鸣音改变情况，如减少明显者可加2分。该患儿2岁，突发喘息1天，计1分；查体两肺广布哮鸣音，计2分；母亲有哮喘史，计1分。总共计4分，沙丁胺醇吸入后，哮鸣音减少加2分，因此总分共计6分（E对）。